慢性镉中毒主要影响
A. 脑
B. 心脏
C. 肝脏
D. 肾脏
E. 甲状腺

正确答案：D。肾脏

解析：本题考查慢性镉中毒的主要影响部位。慢性镉中毒主要影响肾脏（D对ABCE错），肾脏是慢性镉中毒的重要靶器官。慢性镉中毒会引起肾脏功能障碍，包括肾小球滤过率降低、尿液蛋白质增多、尿酸增高、尿比重增加等；此外，还会引起肾脏结构改变，这些改变可以被超声波或CT检查发现，典型的症状有肾小球硬化、肾小球萎缩、慢性肾炎和肾硬化等。